调查食品安全事故的原则是
A. 严谨细致、严厉追责
B. 实事求是、尊重科学
C. 及时准确、维护稳定
D. 客观公正、依法办事
E. 诚实守信、以人为本

正确答案：B。实事求是、尊重科学